某女，25岁。不寐，心烦，口渴，咽燥，口舌生疮，小便短赤，舌尖红，苔薄，脉数，应选用的中成药是
A. 人参归脾丸
B. 天王补心丸
C. 朱砂安神丸
D. 养血安神丸
E. 解郁安神颗粒

正确答案：C。朱砂安神丸

解析：本题考查的是心火炽盛证的辨证论治。不寐，心烦，口渴，咽燥，口舌生疮，小便短赤，舌尖红，苔薄，脉数，应选用的中成药是朱砂安神丸（C对）。心火炽盛证，心烦失眠，发热口渴，便秘尿黄，面红舌赤，苔黄脉数。或狂躁谵语，神识不清；或舌赤生疮，溃烂疼痛；或吐血，衄血；或小便短赤，灼热涩痛。应用的中成药是朱砂安神丸。心悸心脾两虚证【症状】心悸气短，头晕目眩，失眠健忘，面色无华，倦怠乏力，纳呆食少。舌淡红，脉细弱。【中成药应用】心悸兼有脾不统血之便血、崩漏、带下者，宜选用人参归脾丸（A错）。心悸阴虚火旺证【症状】心悸易惊，心烦失眠，五心烦热，口干，盗汗，思虑劳心则症状加重，伴耳鸣腰酸，头晕目眩，急躁易怒。舌红少津，苔少或无，脉细数。【中成药应用】心悸以心肾阴虚为主，兼有心肾不交，阴虚内热者，宜选用天王补心丸（B错）。养血安神丸（D错），养血安神。用于失眠多梦，心悸头晕。阳痿肝郁不舒证【症状】阳事不兴，或举而不坚；伴心情抑郁，胸胁胀满，善太息。舌苔薄白，脉弦。【中成药应用】逍遥丸、加味逍遥丸、解郁安神颗粒（E错）、舒眠胶囊对于阳痿辨证属肝郁不舒者，亦可酌情选用。